可解毒杀虫，补火助阳，通便的药物是
A. 砒石
B. 轻粉
C. 雄黄
D. 硫黄
E. 升药

正确答案：D。硫黄

解析：硫黄的功效是外用解毒杀虫疗疮；内服补火助阳通便（D对）。砒石（A错）的功效是外用攻毒杀虫，蚀疮去腐；内服劫痰平喘，攻毒抑癌。轻粉（B错）的功效是外用杀虫，攻毒，敛疮；内服祛痰消积，逐水通便。雄黄（C错）的功效是解毒杀虫，燥湿祛痰，截疟。升药（E错）的功效是拔毒，去腐。